以下哪种曲线又称Spee曲线
A. 上颌牙列的纵（牙合）曲线
B. 下颌牙列的纵（牙合）曲线
C. 上颌牙列的横（牙合）曲线
D. 下颌牙列的横（牙合）曲线
E. 补偿曲线

正确答案：B。下颌牙列的纵（牙合）曲线

解析：下颌牙列的纵（牙合）曲线又名Spee曲线。掌握“牙列”知识点。